属于半极性溶剂的有
A. 聚乙二醇
B. 丙二醇
C. 脂肪油
D. 二甲基亚砜
E. 醋酸乙酯

正确答案：A、B。聚乙二醇；丙二醇

解析：本题考查非极性溶剂。聚乙二醇（A对）、丙二醇（B对）是半极性溶剂；脂肪油（C错）、乙酸乙酯（E错）为非极性溶剂。二甲亚砜（D错）是极性溶剂。